患者，男，20岁。突发胸闷，气急，咳嗽。听诊：两肺满布哮鸣音。应首先考虑的是
A. 慢性支气管炎喘息型
B. 急性支气管炎
C. 心源性哮喘
D. 支气管哮喘
E. 气胸

正确答案：D。支气管哮喘

解析：患者青年男性，突发胸闷，气急，咳嗽，两肺满布哮鸣音，为哮喘的典型体征，故应首先考虑的诊断是支气管哮喘（D对）。慢性支气管炎喘息型（P19）（A错）患者有两年以上的反复咳嗽、咳痰病史，且多见于老年人。急性支气管炎（P17）（B错）多无胸闷气急的表现，且肺部听诊不会出现哮鸣音。心源性哮喘（P166）（C错）一般为老年人心力衰竭后的表现。气胸（P122）（E错）可出现胸闷气急，但不会闻及哮鸣音。